牙髓有活力，但是从牙周感染牙髓的疾病为
A. 牙髓坏死
B. 慢性根尖周炎
C. 畸形中央尖
D. 年轻恒牙
E. 逆行性牙髓炎

正确答案：E。逆行性牙髓炎

解析：细菌由根方侵入后，牙髓炎症由根髓开始，临床上又称为逆行性牙髓炎。掌握“牙髓坏死、牙髓钙化与牙内吸收”知识点。